可能导致血尿酸升高的药品是
A. 阿司匹林
B. 加替沙星
C. 劳拉西泮
D. 西洛他唑
E. 伪麻黄碱

正确答案：A。阿司匹林

解析：本题考查药物不良反应。可能导致血尿酸升高的药品是阿司匹林（A对）。加替沙星（B错）可能导致血糖异常。劳拉西泮（C错）可能导致低血压。西洛他唑（D错）对血尿酸升高无影响。伪麻黄碱（E错）可能导致高血压。